患者结肠癌右半结肠切除术后两小时，查体：T36.9℃，P85次/分，R21次/分，BP130/85mmHg，意识清醒。此时应该采取的体位
A. 低半坐位
B. 高半坐位
C. 平卧位
D. 侧卧位
E. 头低脚高位

正确答案：A。低半坐位

解析：腹部手术后，多取低半坐位（A对）卧式或斜坡卧位，以减少腹壁张力。施行颈、胸手术后，多采用高半坐位卧式（B错），以便于呼吸及有效引流。脊柱或臀部手术后，可采用俯卧或仰卧（C错）位。腹腔内有污染的病人，在病情许可情况下，尽早改为半坐位或头高脚低位，以便体位引流。休克病人，应取下肢抬高15°~20°，头部和躯干抬高20°~30°的特殊体位。肥胖病人可取侧卧位（E错），有利于呼吸和静脉回流